患者，女，48岁。右乳房发现肿块2个月。查体：右乳头抬高，右乳外上象限可扪及一个2～2.5cm肿块，质硬，表面不平，边界不清。应首先考虑的是
A. 乳腺纤维瘤
B. 乳腺增生病
C. 乳腺癌
D. 乳房结核
E. 乳管扩张症

正确答案：C。乳腺癌

解析：患者乳房肿块2-2.5cm，质硬，表面不平，边界不清应首先考虑的是乳腺癌。是乳腺上皮细胞在多种致癌因子的作用下，发生增殖失控的现象（C对）。乳腺纤维瘤主要为乳房无痛性肿块，很少伴有乳房疼痛或乳头溢液。肿块往往是无意中、洗澡时，或体检中被发现。单发肿块居多，亦可多发，也可两侧乳房同时或先后触及肿块。多为圆形或椭圆形，直径常为1～3cm，亦有更小或更大者，偶可见巨大者。境界清楚，边缘整齐，表面光滑，富有弹性，无压痛，活动度较大，与皮肤无粘连（A错）。乳腺增生病的表现主要特点：生气、劳累过度、有时肩、上肢、背部也有酸胀、困痛（B错）。凡中、青年女性出现乳房肿块，反复感染或脓肿形成，有自行溃破或经久不愈的窦道，或伴有全身性毒血症表现，如低热、体重下降、乏力等，均应考虑有乳房结核的可能（D错）。乳管扩张症出现乳头溢液、乳晕肿块等（E错）。